某市共有200000人，2005年因各种原因死亡2000人。其中心脏病患者712人，死亡104人。则该市的粗死亡率为
A. 104/200000
B. 712/200000
C. 2000/200000
D. 104/712
E. 104/2000

正确答案：C。2000/200000